在治疗剂量下，对LDL-C的降低作用最强，TC次之，降TG作用很弱的药物是
A. 他汀类药物
B. 贝特类药物
C. 噻嗪类药物
D. 酰胺类药物
E. 钙离子拮抗剂

正确答案：A。他汀类药物

解析：他汀类药物在治疗剂量下，对LDL-C的降低作用最强，TC次之，降TG作用很弱。掌握“抗动脉粥样硬化药”知识点。